男性，16岁。低热、咳嗽、咽部不适2周，胸部X线片示两肺下部网状及按小叶分布的斑片状浸润阴影，血WBC10×10⁹/L。治疗药物首选
A. 青霉素
B. 红霉素
C. 氟康唑
D. 雷米封+利福平
E. 病毒唑

正确答案：B。红霉素

解析：该患者为青年男性，出现低热、咳嗽、咽部不适2周，胸部X线片示两肺下部网状及按小叶分布的斑片状浸润阴影（支原体肺炎的典型胸片表现），血WBC10×10⁹/L（正常值4～10×10⁹/L）正常略增高，符合支原体肺炎的临床表现及辅助检查结果，故其治疗应首选大环内酯类抗生素，如红霉素（B对）。而青霉素（A错）多用于肺炎链球菌肺炎的治疗。氟康唑（C错）多用于肺部真菌病的治疗。雷米封+利福平（D错）多用于结核病的治疗。病毒唑（E错）多用于病毒性肺炎的治疗。